治疗稳定型心绞痛首选
A. 尼莫地平
B. 硝苯地平
C. 氨氯地平
D. 地尔硫䓬
E. 尼群地平

正确答案：D。地尔硫䓬